基因重组不包括
A. 转化
B. 转换
C. 接合
D. 转导
E. 转座

正确答案：B。转换

解析：在接合、转化、转导或转座过程中，不同DNA分子间发生的共价连接即为重组。掌握“DNA重组与基因工程”知识点。